患者，女，46岁，诊断为肺结核。在抗结核化疗过程中，出现手足刺痛，考虑为异烟肼所致周围神经病变。宜选用的药物是
A. 口服甲硝唑
B. 肌注肾上腺素
C. 静注地塞米松
D. 口服维生素B₆
E. 肌注维生素K₁

正确答案：D。口服维生素B₆

解析：本题考查异烟肼的不良反应。异烟肼可引起周围神经炎，每日服用维生素B₆（D对）10～50mg可以预防或缓解周围神经炎的发生。